具磺酰脲结构，临床用于治疗糖尿病的药物是
A. 格列齐特
B. 米格列奈
C. 二甲双胍
D. 盐酸吡格列酮
E. 米格列醇

正确答案：A。格列齐特

解析：本题考查格列齐特。格列齐特（A对）属于促胰岛素分泌药，具磺酰脲结构，临床用于治疗糖尿病。米格列奈（B错）为非磺酰脲类促胰岛素分泌药，二甲双胍（C错）为双胍类降糖药，盐酸吡格列酮（D错）属于噻唑烷二酮类胰岛素增敏剂，米格列醇（E错）为α-葡葡糖苷酶抑制剂，以上四种均无磺酰脲的结构。